周围血管疾病用测定双侧肢体皮肤温差的方法判断动脉血流减少情况，温度相差至少应大于
A. 0.5℃
B. 1.5℃
C. 2.5℃
D. 2.0℃
E. 1.0℃

正确答案：D。2.0℃

解析：肢体皮肤温度主要取决于肢体的血流量，血流量越大，皮肤温度越高。周围血管疾病用测定双侧肢体皮肤温差的方法判断动脉血流减少情况，温度相差至少应大于2.0℃（D对）。